为了能够达到前伸（牙合）平衡，全口义齿人工牙前牙应排成
A. 浅覆（牙合）、浅覆盖
B. 浅覆（牙合）、深覆盖
C. 深覆（牙合）、浅覆盖
D. 深覆（牙合）、深覆盖
E. 小开（牙合）、浅覆盖

正确答案：A。浅覆（牙合）、浅覆盖

解析：本题考查排牙原则。为了能够达到前伸（牙合）平衡，全口义齿人工牙前牙应排成浅覆（牙合）、浅覆盖（A对）。全口义齿排牙时，前牙应排列成浅覆（牙合）、浅覆盖，以达到前伸（牙合）平衡，正中（牙合）时前牙不接触。